临床上最为常用的血液制品是
A. 洗涤红细胞
B. 红细胞悬液（添加剂红细胞）
C. 浓缩白（粒）细胞
D. 普通冰冻血浆
E. 冷沉淀

正确答案：B。红细胞悬液（添加剂红细胞）

解析：红细胞悬液（B对）又称悬浮红细胞，是全血经离心去除大部分血浆后，加入红细胞保存液制备而成的。悬浮红细胞由于移去了大部分血浆，可减少血浆引起的副作用。由于加入保存液，不仅能更好地保存红细胞，还具有稀释作用，使输注更流畅。可应用于慢性贫血和急性失血的治疗中，是临床上应用最广泛的血液制品。洗涤红细胞（A错）主要用于对白细胞凝集素有发热反应者及肾功能不全不能耐受库存血中高钾者。浓缩白（粒）细胞（C错）属于白细胞制剂，输注后并发症多，现已较少应用。普通冰冻血浆（P25）（D错）是指新鲜冰冻血浆在4℃溶解时除去冷沉淀成分冻存的上清血浆制品，可用于多种凝血因子缺乏症、肝胆疾病引起的凝血障碍和大量输库存血后的出血倾向。冷沉淀（P25）（E错）是新鲜冷冻血浆在4℃溶解时不融的沉淀物，主要用于血友病甲、先天或获得性纤维蛋白缺乏症等。